休克早期的临床表现哪项不对
A. 烦燥不安
B. 脉搏细数
C. 血压明显下降
D. 面色苍白，出冷汗
E. 少尿

正确答案：C。血压明显下降

解析：休克早期即微循环缺血期，此期患者表现为脸色苍白，出冷汗（D对），四肢湿冷，脉搏细数（B对），脉压减小，少尿（E对），烦躁不安（A对）。由于血液的重新分配，心、脑灌流量此时仍可维持正常。因此，患者在休克代偿期间神志一般是清楚的，但常显得烦躁不安（图13-4)。该期患者血压可骤降（如大失血），也可略降，甚至因代偿作用可正常或轻度升高（C错，为本题正确答案），但是脉压会明显缩小，患者脏器有效灌流量明显减少。